中年男性，冠心病长期口服阿司匹林，大量饮酒后呕血800ml，查体上腹部轻压痛，余无异常，明确诊断首选辅助检查
A. B超
B. X线钡餐检查
C. 胃镜
D. 腹部CT
E. 腹部平片

正确答案：C。胃镜

解析：患者中年男性，冠心病长期口服阿司匹林，大量饮酒后呕吐鲜血（上消化道出血的特征表现），结合患者的病史和表现，首选行胃镜检查明确诊断（E对），胃镜检查是诊断UGIB和LGIB病因、部位和出血情况的首选方法。